简略寿命表的编制需要调查某地某人群的
A. 年龄组死亡率
B. 总死亡率
C. 人口构成比
D. 某病的年龄别死亡率

正确答案：A。年龄组死亡率

解析：本题考查简略寿命表的编制。简略寿命表的编制需要调查某地某人群的年龄组死亡率（A对BCD错）。某年龄组死亡率为相应的实际死亡人数与某年龄组人口数之比。